女，28岁。发作性干咳、胸闷3年，夜间明显，无咯血、发热。每年发作2～3次，约1～2周可自行缓解。近2天来再次出现上述症状而就诊。查体：双肺呼吸音清晰，未闻及干湿性啰音，心率86次/分，心脏各瓣膜听诊区未闻及杂音。胸部X线片未见异常，肺通气功能正常。为明确诊断，应采取的进一步检查是
A. 支气管镜
B. 胸部高分辨CT
C. 胸部MRI
D. 胸部增强CT
E. 支气管激发试验

正确答案：E。支气管激发试验

解析：患者为青年女性，发作性干咳、胸闷3年，夜间明显，无咯血、发热，每年发作2～3次，约1～2周可自行缓解，心肺检查未见异常，考虑为支气管哮喘（支气管哮喘的典型症状为发作性伴有哮鸣音的呼气性呼吸困难，症状可在数分钟内发生，并持续数小时至数天，可经平喘药物治疗后缓解或自行缓解，夜间及凌晨发作或加重是哮喘的重要临床特征）。此外，临床上还存在没有喘息症状的不典型哮喘，患者可表现为发作性咳嗽、胸闷或其他症状。对以咳嗽为唯一症状的不典型哮喘称为咳嗽变异性哮喘（CVA）。对以胸闷为唯一症状的不典型哮喘称为胸闷变异性哮喘（CTVA）。该患者发作性干咳、胸闷，无明显哮鸣音，符合不典型哮喘的特征，应进一步做支气管激发试验以确诊（E对）。支气管镜（A错）可用于中央型肺癌的诊断。胸部高分辨CT（B错）是支气管扩张和间质性肺疾病的首选诊断方法。胸部MRI（C错）、胸部增强CT（D错）可用于胸部肿瘤等占位性病变的诊断。